集中式给水水源选择有以下几个原则，除了
A. 水量充足
B. 用水方便
C. 水质良好
D. 便于防护
E. 技术经济上合理

正确答案：B。用水方便

解析：本题考查集中式给水水源选择的原则。集中式给水水源选择的原则包括：1.水量充足（A对）：水源的水量应能满足城镇或居民点的总用水量，并考虑近期和远期的发展；2.水质良好（C对）：水源水质应符合规定要求；3.便于防护（D对）：旨在保证水源水质不致因污染而恶化。有条件时宜优先选用地下水。采用地表水作水源时，应结合城市发展规划，将取水点设在城镇和工矿企业的上游，以防止水源污染；4.技术经济上合理（E对）：选择水源时，在分析比较各个水源的水量和水质后，可进一步结合水源水质和取水、净化、输水等具体条件，考虑基本建设投资费用最小的方案。用水方便（B错，为本题正确答案）不属于集中式给水水源选择的原则。